男，28岁，船民，昨晚进食海蟹一只，晨起腹泻稀水便，10小时内排便20余次，量多，水样，无臭味，中午呕吐3～4次，初起水样，后为米泔水样。发病后无排尿，就诊时呈重度脱水征，神志淡漠，BP80／50mmHg，下列检查均有助于诊断，除了
A. 血培养
B. 血清凝集试验
C. 大便悬滴镜检
D. 大便碱性蛋白胨增菌培养
E. 大便涂片革兰染色镜检

正确答案：A。血培养

解析：28岁男性患者，职业船民，昨晚进食海蟹一只（接触霍乱弧菌传染源），晨起腹泻稀水便，10小时内排便20余次，量多，水样，无臭味，中午呕吐3～4次，初起水样，后为米泔水样（霍乱泻吐期典型临床表现）；发病后无排尿，就诊时呈重度脱水征，神志淡漠（重度脱水），BP80/50mmHg（霍乱脱水期临床表现），根据患者的个人史、临床表现可拟诊为霍乱，典型的临床表现为急性起病，剧烈腹泻、呕吐，以及由此引起的脱水、机头痉挛，严重者导致循环衰竭和急性肾衰竭。霍乱弧菌不进入血液循环，因此血培养（A错，为本题正确答案）无诊断价值。血清凝集试验（B对）用于检测抗菌抗体中的抗凝集抗体，一般在发病第5天出现，有助于诊断，但并不适用于本题患者的快速诊断，主要用于流行病学的追溯诊断和粪便培养阴性可疑病人的诊断。大便悬滴镜检（C对）可见穿梭状运动的弧菌为霍乱流行期间的快速诊断方法。大便碱性蛋白胨增菌培养（D对）对所有怀疑霍乱患者的粪便，除显微镜检查外，都应用来辅助诊断。大便涂片革兰染色镜检（E对）时显微镜下可见粪便涂片革兰染色阴性的弧菌，呈鱼群样排列。